强力枇杷露的功效是
A. 清热化痰，降气平喘
B. 清肺止咳，化痰
C. 清热化痰，敛肺止咳
D. 清热化痰，宣肺止咳
E. 清肺润燥，化痰止咳

正确答案：C。清热化痰，敛肺止咳

解析：本题考查的是强力枇杷露的功能。强力枇杷露的功效是清热化痰，敛肺止咳（C对）。强力枇杷露：【功能】清热化痰，敛肺止咳。清肺抑火丸：【功能】清肺止咳，化痰（B错）通便。急支糖浆：【功能】清热化痰，宣肺止咳（D错）。二母宁嗽丸：【功能】清肺润燥，化痰止咳（E错）。功能为清热化痰，降气平喘（A错）的中成药，2022年考试指南未明确说明。